眶与鼻腔相交通的途径
A. 眶下裂
B. 眶下管
C. 眶下孔
D. 下颌管
E. 鼻泪管

正确答案：E。鼻泪管

解析：眶的内侧壁前下份有泪囊窝，此窝向下经鼻泪管通鼻腔 （E对）。